原植物属于菊科的药材有
A. 车前草
B. 茵陈
C. 青蒿
D. 蒲公英
E. 石斛

正确答案：B、C、D。茵陈；青蒿；蒲公英

解析：本题考查的是茵陈、青蒿与蒲公英的来源。原植物属于菊科的药材有茵陈（B对）、青蒿（C对）与蒲公英（D对）。茵陈：【来源】为菊科植物滨蒿或茵陈蒿的干燥地上部分。青蒿：【来源】为菊科植物黄花蒿的干燥地上部分。蒲公英：【来源】为菊科植物蒲公英、碱地蒲公英或同属数种植物的干燥全草。车前草（A错）：【来源】为车前科植物车前或平车前的干燥全草。石斛（E错）：【来源】为兰科植物金钗石斛、霍山石斛、鼓槌石斛或流苏石斛的栽培品及其同属植物近似种的新鲜或干燥茎。